不良反应最小，可进入脑脊液的咪唑类抗真菌药是
A. 咪康唑
B. 氟康唑
C. 氟胞嘧啶
D. 克霉唑
E. 酮康唑

正确答案：B。氟康唑

解析：本题考查唑类抗真菌药。不良反应最小，可进入脑脊液的咪唑类抗真菌药是氟康唑（B对）。咪康唑（A错）为广谱抗真菌药，口服时生物利用度低，静脉注射给药不良反应较多，目前临床主要局部应用治疗阴道、皮肤或指甲的真菌感染。氟胞嘧啶（C错）属于嘧啶类人工合成的广谱抗真菌药，易透过血脑屏障，对隐球菌性脑膜炎有较好疗效，但不主张单独应用，常与两性霉素B合用。克霉唑（D错）为广谱抗真菌药，口服不易吸收，血药峰浓度较低，局部用药治疗各种浅部真菌感染。酮康唑（E错）是第一个广谱抗真菌药，口服可有效地治疗深部、皮下及浅表真菌感染，亦可局部用药治疗表浅部真菌感染，口服不良反应较多。